男，51岁，重症肺炎患者，入院后次日病情加重，突发持续性呼吸急促，发绀，伴烦躁，呼吸频率38次/分，心率108次/分，律齐，两肺可闻及湿啰音。血气分析：pH7.34，PaO₂50mmHg，PaCO₂30mmHg。胸片示两中下肺纹理增多模糊，斑片状阴影，心胸比例正常。对输液的要求是
A. 入量＞出量（＞500ml）
B. 入量＞出量（＞600ml～1000ml）
C. 入量=出量
D. 入量＜出量（＜500ml～1000ml）
E. 不限制胶体溶液

正确答案：D。入量＜出量（＜500ml～1000ml）

解析：患者为中老年男性，患有重症肺炎（重症肺炎为急性呼吸窘迫综合征的危险因素），入院后次日病情加重，突发持续性呼吸急促，发绀，伴烦躁，呼吸频率38次/分，心率108次/分，律齐，两肺可闻及湿啰音，血气分析：pH7.34，PaO₂50mmHg（正常为＞60mmHg），PaCO₂30mmHg（正常为35～45mmHg）（符合ARDS的典型改变为PaO₂降低，PaCO₂降低），胸片示两中下肺纹理增多模糊，斑片状阴影，符合成人呼吸窘迫综合征（ARDS）的临床表现及辅助检查，诊断为ARDS。ARDS的患者以可以允许的较低循环容量来维持有效循环，严格控制输入的液体量，保持体液的负平衡，每天出入液体量一般控制在入量比出量少500ml左右（D对ABC错）。ARDS早期，除非有低蛋白血症，否则不宜输注胶体液（E错）。